不符合肾小球源性血尿的是
A. 可有红细胞管型
B. 无痛
C. 合并大量蛋白尿
D. 变形红细胞为主
E. 红细胞呈均一性

正确答案：E。红细胞呈均一性

解析：肾小球源性血尿的特点有：镜下红细胞大小不一、形态多样为肾小球性血尿，见于肾小球肾炎。因红细胞从肾小球基底膜漏出，通过具有不同渗透梯度的肾小管时，化学和物理作用使红细胞膜受损，血红蛋白溢出而变形（ABCD对）。红细胞呈均一性不属于肾小球源性血尿的特点(E错，为本题正确答案)。